关于膀胱毗邻的叙述，不正确的是
A. 前方邻耻骨联合，空虚时膀胱尖不超过耻骨联合上缘的平面
B. 在男性，膀胱后方邻精囊、输精管壶腹及直肠
C. 在女性，膀胱后方邻子宫与阴道
D. 在男性，膀胱的下方邻接前列腺和尿道球腺
E. 在女性，膀胱下方邻盆膈

正确答案：D。在男性，膀胱的下方邻接前列腺和尿道球腺

解析：膀胱前方邻耻骨联合，空虚时全部位于盆腔内，膀胱尖不超过耻骨联合上缘的平面（A对）。男性膀胱后方邻精囊、输精管壶腹及直肠（B对），女性膀胱后方邻子宫与阴道（C对）。男性膀胱的下方邻接前列腺（D错，为本题正确答案），女性膀胱下方邻盆膈（E对）。